组织学上，有序的活体骨和与负重的种植体之间直接的结构和功能的连接，二者之间无任何软组织，称为
A. 龈界面
B. 袖口
C. 骨整合
D. 种植体-软组织界面
E. 以上均不正确

正确答案：C。骨整合

解析：本题考查种植体周围组织。组织学上，骨整合（C对）是指有序的活体骨和与负重的种植体之间直接的结构和功能的连接，二者之间无任何软组织。